左侧卵巢静脉一般汇入
A. 髂总静脉
B. 髂内静脉
C. 髂外静脉
D. 肾静脉
E. 腹主静脉

正确答案：D。肾静脉

解析：右侧卵巢静脉汇入下腔静脉，左侧卵巢静脉汇入左肾静脉（D对）。